男，48岁，颈增粗20年，近一年消瘦10公斤，并有心悸。体检发现双侧甲状腺多个结节。基础代谢率+31%，2小时内甲状腺摄碘29%。甲状腺手术后1天，病人手足抽搐时处理方法是立即
A. 测定血清钙浓度
B. 口服钙剂
C. 口服二氢速固醇
D. 静脉注射10%葡萄糖酸钙10～20ml
E. 行甲状旁腺移植术

正确答案：D。静脉注射10%葡萄糖酸钙10～20ml

解析：患者甲状腺手术后一天，出现手足抽搐，考虑手术损伤甲状旁腺，导致甲状旁腺激素降低，引起血钙降低，神经肌肉应激性显著增高，出现手足抽搐。静脉注射10%葡萄糖酸钙10～20ml（D对）可迅速提高血钙，缓解手足抽搐症状。测定血清钙浓度（A错）可用于确诊低血钙，但无法用于治疗低血钙。口服钙剂（B错）、口服二氢速固醇（C错）可升高血钙，但起效缓慢，不适用于手足抽搐的急救处理。行甲状旁腺移植术（E错）可用于治疗永久性甲状旁腺功能减退，亦不适用于手足抽搐的急救处理。